股骨
A. 约为身高1/5
B. 股骨头朝向内上后方
C. 股骨颈不易骨折
D. 股骨体后面的纵行骨嵴为粗线
E. 下端与胫、腓骨相连结

正确答案：D。股骨体后面的纵行骨嵴为粗线

解析：股骨体后面有纵行骨嵴，称粗线（D对）。是人体最长最结实的长骨，其长度约为体高的 1/4（A错），上端有朝向内上的股骨头（B错），头下外侧的狭细部称股骨颈，易骨折，股骨下端与胫、腓骨相关节（C错）。